生脉散与四君子汤的组成中均含有药物是
A. 茯苓
B. 附子
C. 白术
D. 甘草
E. 人参

正确答案：E。人参

解析：生脉散功能功能益气生津，敛阴止汗，由人参、麦冬、五味子组成。四君子汤功能益气健脾，由人参、白术、茯苓、甘草组成。故生脉散与四君子汤均含有的药物为人参（E对）。记忆：四君子参苓白术草。生脉畏（味）参麦。